有关掌浅弓的描述，正确的是
A. 由尺动脉的掌浅支与桡动脉的掌浅支吻合形成的
B. 位置表浅仅覆以皮肤与浅筋膜
C. 弓凸向远侧，最凸部分不超过第二条掌横纹
D. 发出指掌侧总动脉供应1－5指
E. 指掌侧固有动脉沿手指掌侧下行，并与相对侧同名动脉吻合

正确答案：C。弓凸向远侧，最凸部分不超过第二条掌横纹

解析：掌浅弓由尺动脉的末端与桡动脉的掌浅支（A错）吻合而成。弓凸向远侧，最凸部分不超过第二条掌横纹（C对）。发出指掌侧总动脉供应2～5指（D错）。